阴挺之气虚证的主治方剂是
A. 四君子汤
B. 六君子汤
C. 补中益气汤
D. 八珍汤
E. 以上均非

正确答案：C。补中益气汤

解析：阴挺之气虚证应补中益气，升阳举陷，用补中益气汤，方中人参，黄芪，甘草益气升提，白术健脾除湿，升麻，柴胡升阳当归补血，陈皮理气，全方健脾益气，升清降浊，固摄冲任，提系子宫（C对）。四君子汤益气健脾，主治脾胃气虚证（A错）。六君子汤益气健脾，燥湿化痰（C错）。八珍汤益气补血，主治气血两亏证（D错）。